下列有关RNA的叙述哪一项是不正确的
A. RNA分子也有双螺旋结构
B. tRNA是分子量最小的RNA
C. 胸腺嘧啶是RNA的特有碱基
D. rRNA参与核蛋白体的组成
E. mRNA是生物合成多肽链的直接模板

正确答案：C。胸腺嘧啶是RNA的特有碱基

解析：DNA和RNA中含有的嘌呤碱主要为腺嘌呤（A）和鸟嘌呤（G）；组成DNA的嘧啶碱主要有胸腺嘧啶（T）和胞嘧啶（C），RNA分子中主要为尿嘧啶（U）及胞嘧啶（C）。掌握“RNA”知识点。